根据《中药品种管理办法实施条例》，国家对获得生产含有新型化学成分药品许可的生产者提交的，自行取得且未披露试验数据的保护期是
A. 10年
B. 7年
C. 6年
D. 5年
E. 3年

正确答案：C。6年

解析：本题考查药品管理。根据《中药品种管理办法实施条例》，国家对获得生产含有新型化学成分药品许可的生产者提交的，自行取得且未披露试验数据的保护期是6年（C对）。